可摘局部义齿中起连接、稳定与固位作用的部分是
A. 固位体
B. 人工牙
C. 基托
D. 大连接体
E. 小连接体

正确答案：C。基托

解析：本题考查可摘局部义齿中起连接、稳定与固位作用的部分。可摘局部义齿的各个组成部分都有其主要作用和次要作用，各部分间又可起协同作用，按其作用可归纳为三部分：①修复缺损和恢复功能部分：人工牙、基托、支托；②固位及稳定部分：各种直接固位体、间接固位体、基托、支托；③连接传力部分：基托、连接体、连接杆、支托。综上，起连接、稳定与固位作用的部分是基托（C对）和支托。固位体（A错）是可摘局部义齿用以抵抗脱位力的部件，其作用是固位、稳定、支持，无连接作用。人工牙（B错）是义齿中代替缺失牙建立咬合关系，恢复咀嚼功能和外形的部分，起修复缺损、恢复功能的作用。大连接体（D错）、小连接体（E错）是将义齿各部分连接在一起，同时还有传递和分散牙合力的作用。